小柴胡汤可用于治疗
A. 少阳湿热证
B. 寒热互结
C. 热入血室
D. 黄疸见大便秘结
E. 痰湿内阻膜原

正确答案：C。热入血室

解析：小柴胡汤可用于治疗热入血室证。若妇人经期，感受风邪，邪热内传，热与血结，血热瘀滞，疏泄失常，则经水不当断则断，寒热发作有时（C对）。少阳湿热证是少阳经脉感受湿热之邪（A错）。寒热互结指中气虚弱，寒热错杂，虚实并见（B错）。黄疸见大便秘结由邪热入里，与脾湿相合,气机受阻所致（D错）。痰湿内阻膜原为痰湿阻滞在阳明半表半里之间（E错）。